属足太阴脾经的腧穴是
A. 血海
B. 少海
C. 小海
D. 照海
E. 气海

正确答案：A。血海

解析：本题考查各经脉的腧穴。血海为足太阴脾经的腧穴（A对）。少海为手少阴心经合穴（B错）。小海为手太阳小肠经合穴（C错）。照海为足少阴肾经的腧穴（D错）。气海属任脉穴（E对）。